氢化可的松的抗炎作用机制
A. 抑制磷脂酶A₂
B. 稳定肥大细胞膜和溶酶体膜
C. 抑制诱导型NO合酶表达
D. 抑制肉芽组织形成
E. 抑制环氧酶-2表达

正确答案：A、C、D、E。抑制磷脂酶A₂；抑制诱导型NO合酶表达；抑制肉芽组织形成；抑制环氧酶-2表达

解析：本题考查氢化可的松的抗炎作用机制。氢化可的松为糖皮质激素类药物，通过以下环节抑制炎症过程：1.对炎症抑制蛋白及某些靶酶的影响：①增加炎症抑制蛋白脂皮质素1的生成，继之抑制磷脂酶A₂（A对），影响花生四烯酸代谢的连锁反应，使具有扩血管作用的前列腺素（PGE₂、PGI₂等）和有趋化作用的白三烯类（LTA₄、LTB₄、LTC₄和LTD₄）等炎症介质减少；②抑制一氧化氮合酶和环加氧酶-2等的表达（CE对），从而阻断NO、PGE₂等相关介质的产生；③诱导血管紧张素转化酶的生成，以降解可引起血管舒张和致痛作用的缓激肽。2.抑制多种炎性细胞因子的产生，在转录水平上抑制黏附分子的表达。3.诱导炎症细胞的凋亡。4.非基因组效应。在炎症后期，糖皮质激素可通过抑制毛细血管和成纤维细胞的增生，抑制胶原蛋白、黏多糖的合成以及肉芽组织增生（D对），防止黏连及瘢痕形成。稳定肥大细胞膜和溶酶体膜（B错）是糖皮质激素类药物抗休克的作用机制。